一般宜在春末夏初采收的中药是
A. 根及根茎类中药
B. 全草类中药
C. 果实种子类中药
D. 茎木类中药
E. 皮类中药

正确答案：E。皮类中药

解析：本题考查的是要药材的采收原则。一般宜在春末夏初采收的中药是皮类中药（E对）。植物类药材药用部分不同，采收时间也不同：（1）根及根茎类（A错）：一般在秋、冬两季植物地上部分将枯萎时及春初发芽前或刚露苗时采收，此时根或根茎中贮藏的营养物质最为丰富，通常所含有效成分也比较高，如牛膝、党参、黄连、大黄、防风等。但也有例外，有些中药由于植株枯萎时间较早，即在夏季及时采收，如浙贝母、延胡索、半夏、太子参等；而明党参则在春季采收较好。（2）茎木类（D错）：一般在秋、冬两季采收，此时有效物质积累丰富，如大血藤、鸡血藤、首乌藤、忍冬藤等藤茎类。而木类药材全年均可采收，如苏木、降香、沉香等。（3）皮类：一般在春末夏初采收，此时树皮养分及液汁增多，形成层细胞分裂较快，皮部和木部容易剥离，伤口较易愈合，如黄柏、厚朴、秦皮等。少数皮类药材于秋、冬两季采收，此时有效成分含量较高，如川楝皮、肉桂等。根皮通常在挖根后剥取，或趁鲜抽去木心，如牡丹皮、五加皮等。（4）叶类：多在植物光合作用旺盛期，开花前或果实成熟前采收，如艾叶、臭梧桐叶等。少数药材宜在秋、冬时节采收，如桑叶等。（5）花类：一般不宜在花完全盛开后采收，开放过久几近衰败的花朵，不仅药材的颜色和气味不佳，而且有效成分的含量也会显著减少。花类中药在含苞待放时采收的如金银花、辛夷、丁香、槐米等；在花初开时采收的如洋金花等；在花盛开时采收的如菊花、西红花等；红花则要求花冠由黄变红时采摘。对花期较长，花朵陆续开放的植物，应分批采摘，以保证质量。有些中药如蒲黄、松花粉等不宜迟收，过期则花粉自然脱落，影响产量。（6）果实种子类（C错）：一般果实多在自然成熟时采收，如瓜蒌、栀子、山楂等；有的在成熟经霜后采摘为佳，如山茱萸经霜变红，川楝子经霜变黄；有的采收未成熟的幼果，如枳实、青皮等。若果实成熟期不一致，要随熟随采，过早肉薄产量低，过迟肉松泡，影响质量，如木瓜等。种子类药材需在果实成熟时采收，如牵牛子、决明子、芥子等。（7）全草类（B错）：多在植物充分生长，茎叶茂盛时采割，如青蒿、穿心莲、淡竹叶等；有的则在花期采收，如薄荷、益母草、荆芥、香薷等。全草类中药采收时大多割取地上部分，少数连根挖取全株药用，如金钱草、蒲公英等。茵陈有两个采收时间，春季幼苗高6～10cm时或秋季花蕾长成时。春季采的习称“绵茵陈”，秋季采的习称“花茵陈”。（8）藻、菌、地衣类：不同的药用部位，采收情况不同。如茯苓在立秋后采收质量较好；马勃宜在子实体刚成熟时采收，过迟则孢子散落；冬虫夏草在夏初子座出土孢子未发散时采挖；海藻在夏、秋两季采捞。